可用作乳剂的乳化剂的是
A. 羟苯酯类
B. 阿拉伯胶
C. 阿司帕坦
D. 胡萝卜素
E. 氯化钠

正确答案：B。阿拉伯胶

解析：本题考查乳剂。阿拉伯胶（B对）为天然乳化剂，由于亲水性强，能形成O/W型乳剂，多数有较大的黏度，能增加乳剂的稳定性。常用的天然乳化剂还有西黄蓍胶、明胶、杏树胶、卵黄等。羟苯酯类（A错）为液体制剂常用的防腐剂。阿司帕坦（C错）为甜味剂。胡萝卜素（D错）一种天然的着色剂。氯化钠（E错）为液体制剂制备中常用的渗透压调节剂。